触诊检查淋巴结应检查的内容，不包括
A. 淋巴结的部位
B. 淋巴结的大小
C. 淋巴结的数目
D. 淋巴结的活动度
E. 淋巴结的主要功能

正确答案：E。淋巴结的主要功能

解析：触诊检查淋巴结时应注意肿大淋巴结所在的部位、大小、数目、硬度、活动度、有无压痛或波动感及与皮肤或基底部有无粘连等情况。掌握“口外一般检查及辅助检查”知识点。